以下不属于硅酸盐肺特点的是
A. 弥漫性肺间质纤维化
B. 肺结核的合并率高
C. 胸部X线片改变以不规则小阴影为主
D. 自觉症状和临床体征一般较明显
E. 肺部感染和胸膜炎等并发症多见

正确答案：B。肺结核的合并率高